知母的归经是
A. 肺、胃、肾经
B. 肺、脾、肾经
C. 心、脾、肾经
D. 心、肝、肾经
E. 心、肝、脾经

正确答案：A。肺、胃、肾经

解析：知母苦、甘，寒。归肺、胃、肾经（A对）。归肺、脾、肾经（B错）的中药有京大戟、芫花等药。归心、脾、肾经（C错）的中药有附子。归心、肝、肾经（D错）的中药有磁石、龙骨、龟甲。归心、肝、脾经（E错）的中药有乳香、没药、苏木等。